蚀刻法复合树脂的粘接机理
A. 螯合
B. 化学键
C. 范德华力
D. 机械粘结
E. 结合共聚

正确答案：D。机械粘结

解析：本题考查蚀刻法复合树脂的粘接机理。蚀刻法复合树脂的粘接机理是机械粘结（D对）。酸蚀技术是指牙釉质经酸处理后，由光滑的表面变成具有高表面自由能的蜂窝状表面，形成5～50μm的微孔层，低黏度的树脂粘接剂借助毛细作用渗入微孔中，聚合形成树脂“釉质的微机械嵌合”，即树脂突。